西方国家最古老医学道德文献
A. 《纽伦堡法典》
B. 《道德与文明》
C. 希波克拉底誓言
D. 日内瓦宣言
E. 荷兰会议

正确答案：C。希波克拉底誓言

解析：西方国家最古老医学道德文献是《希波克拉底誓言》（C对）。《希波克拉底誓言》是希波克拉底及其学派在长期的医学实践中总结出来的医德行为准则，是历史上倡导医德最早、最系统、最重要的文献，为后来医德的发展起到了不可磨灭的奠基作用。